医疗机构提交的医疗事故技术鉴定资料指
A. 医嘱单
B. 检验报告
C. 手术同意书
D. 封存保留的输液药物
E. 以上说法均正确

正确答案：E。以上说法均正确

解析：医疗机构应当提交下列有关医疗事故技术鉴定的材料：①住院患者的病程记录、死亡病例讨论记录、疑难病例讨论记录、会诊意见、上级医师查房记录等病历资料原件；②住院患者的住院日志、体温单、医嘱单、化验单（检验报告）、医学影像检查资料、特殊检查同意书、手术同意书、手术及麻醉记录单、病理资料、护理记录等病历资料原件；③抢救急危患者，在规定时间内补记的病历资料原件；④封存保留的输液、注射用物品和血液、药物等实物，或者依法具有检验资格的检验机构对这些实物作出的检验报告；⑤与医疗事故技术鉴定有关的其他材料。在医疗机构建有病历档案的门诊、急诊患者，其病历资料由医疗机构提供；没有在医疗机构建立病历档案的，由患者提供。医患双方应当依照规定提交相关材料。掌握“医疗事故的技术鉴定”知识点。